患者黄疸初期，目白睛微黄，或不明显，恶心欲吐，发热恶寒，无汗身痛，小便短赤，舌苔薄黄腻，脉弦滑。治疗应首选方剂
A. 麻黄连翘赤小豆汤
B. 小柴胡汤
C. 大柴胡汤
D. 甘露消毒丹
E. 茵陈蒿汤

正确答案：A。麻黄连翘赤小豆汤

解析：根据黄疸初期，目睛微黄，恶心欲吐，发热恶寒舌苔黄腻等判断为阳黄的湿热兼表证，故采用麻黄连翘赤小豆汤（A对）清热化湿解表；小柴胡汤（B错）为治疗半表半里的少阳证，表现为寒热往来；大柴胡汤（C错）治疗胆经郁热的黄疸，身目黄染严重；甘露消毒丹（D错）没有解表等等功效，而题中有发热恶寒，无汗身痛等表证；茵陈蒿汤（E错）治疗热重于湿的阳黄，身目黄染，黄色鲜明。